红细胞转酮醇酶活力测定是评价哪种维生素营养状况的指标
A. 维生素A
B. 维生素B₁
C. 维生素C
D. 维生素D
E. 维生素E

正确答案：B。维生素B₁